白喉杆菌的毒力鉴定根据
A. 菌体的异染颗粒特征
B. 吕氏血清培养基上快速生长特点
C. 亚碲酸钾平板上菌落特征
D. Elek平板试验
E. 锡克试验

正确答案：D。Elek平板试验

解析：毒力试验是鉴别产毒白喉棒状杆菌与其他棒状杆菌的重要方法，体外法常用琼脂Elek平板毒力试验（D对），若待检菌株产生白喉毒素，则会在浸有白喉抗毒素分人纸条与菌苔交界处出现有白色沉淀线，无毒菌株则不产生沉淀线；体内法是通过豚鼠体内中和试验测定毒力。异染颗粒（A错）是白喉棒状杆菌的生物学特性，主要成分是核糖核酸和多偏磷酸盐，对鉴定细菌具有重要意义，无法鉴定毒力（P164）。白喉棒状杆菌在吕氏培养基上生长迅速（B错），可形成典型的圆形灰白色小菌落，异染颗粒明显，易于鉴别细菌，而无法鉴定毒力（P164）。白喉棒状杆菌在亚碲酸钾血平板（C错）上生长时，菌落呈黑色，且能抑制其他杂菌生长，根据三种不同典型菌落特征，可对其进行分型，但无法进行毒力鉴定（P164）。锡克试验（E错）可测人群免疫水平，其原理是外毒素和抗毒素的中和反应，不用于毒力鉴定。